急性毒作用带为
A. 半数致死剂量/急性阈剂量的比值
B. 急性阈剂量/半数致死剂量的比值
C. 急性阈剂量/慢性阈剂量的比值
D. 慢性阈剂量/急性阈剂量的比值

正确答案：A。半数致死剂量/急性阈剂量的比值

解析：本题考查急性毒作用带。急性毒作用带为半数致死剂量/急性阈剂量的比值（A对BCD错）。急性毒作用带值小，说明化学物质从产生轻微损害到导致急性死亡的剂量范围窄，引起死亡的危险性大；反之，则说明引起急性中毒死亡的危险性小。